治疗四肢拘挛疼痛，应首选的药物是
A. 人参
B. 当归
C. 白芍
D. 阿胶
E. 黄芪

正确答案：C。白芍

解析：白芍具有养血敛阴，柔肝止痛，平抑肝阳的功效，可用于肝血亏虛，月经不调；肝脾不和，胸胁脘腹疼痛，四肢挛急疼痛（C对）；肝阳上亢，头痛眩晕。人参具有大补元气，补脾益肺，生津，安神益智的功效，可治疗元气虛脱证；肺脾心肾气虚证；热病气虛津伤口渴及消渴证（A错）。当归是补虚药，具有补血调经，活血止痛，润肠通便的功效。可用于血虛诸证；血虛血瘀，月经不调，经闭，痛经；虚寒性腹痛，跌打损伤，痈疽疮疡，风寒痹痛；血虚肠燥便秘（B错）。阿胶具有补血，滋阴，润肺，止血的功效（D错）。黄芪具有补气健脾，升阳举陷，益卫固表，利尿消肿，托毒生肌的功效（E错）。